某男，50岁。患流行性感冒，症见发热、恶寒、肌肉酸痛、鼻塞流涕、咳嗽、头痛、咽干咽痛，舌偏红，苔黄腻。证属热毒袭肺，宜选用的成药是
A. 连花清瘟颗粒
B. 桑菊感冒片
C. 桂枝合剂
D. 参苏丸
E. 九味羌活颗粒

正确答案：A。连花清瘟颗粒

解析：本题考查的是连花清瘟胶囊的主治。患流行性感冒，症见发热、恶寒、肌肉酸痛、鼻塞流涕、咳嗽、头痛、咽干咽痛，舌偏红，苔黄腻。证属热毒袭肺，宜选用的成药是连花清瘟颗粒（A对）。连花清瘟胶囊：【主治】流行性感冒属热毒袭肺证，症见发热、恶寒、肌肉酸痛、鼻塞流涕、咳嗽、头痛、咽干咽痛、舌偏红、苔黄或黄腻。桑菊感冒片（B错）：【主治】风热感冒初起，头痛，咳嗽，口干，咽痛。桂枝合剂（C错）：【主治】感冒风寒表虚证，症见头痛发热、汗出恶风、鼻塞干呕。参苏丸（D错）：【主治】身体虚弱，感受风寒所致的感冒，症见恶寒发热、头痛鼻塞、咳嗽痰多、胸闷呕逆、乏力气短。九味羌活颗粒（E错）：【主治】外感风寒夹湿所致的感冒，症见恶寒、发热、无汗、头重而痛、肢体酸痛。